引出Chaddock征提示
A. 皮质脑干束损害
B. 脊髓丘脑束损害
C. 锥体束损害
D. 薄束损害
E. 楔束损害

正确答案：C。锥体束损害

解析：Chaddock征操作方法：由外踝下方向前划至足背外侧。出现趾背屈为阳性，属于巴宾斯基等位征，病理意义同巴宾斯基征，提示锥体束受损（C对）。薄束（D错）、楔束（E错）、脊髓丘脑束（B错）均为感觉神经传导纤维束，损伤出现感觉障碍。皮质脑干束损害（A错）表现为交叉性瘫痪。